盐酸普鲁卡因注射液中的特殊杂质
A. 二苯酮衍生物
B. 酮体
C. 苯酚
D. 对氨基酚
E. 对氨基苯甲酸

正确答案：E。对氨基苯甲酸

解析：本题考查盐酸普鲁卡因的特殊杂质。对氨基苯甲酸酯类局麻药结构中有酯键，可发生水解反应。特别是在注射液制备过程中受灭菌温度、时间、溶液pH、贮藏时间以及光线和金属离子等因素的影响，易发生水解反应生成对氨基苯甲酸类（E对）的杂质，其中对氨基苯甲酸随贮藏时间的延长或受热，可进一步脱羧转化为苯胺，而苯胺又可被氧化为有色物，使注射液变黄、疗效下降、毒性增加。二苯酮衍生物（A错）是地西泮的特殊杂质。酮体（B错）和苯酚（C错）是苯乙胺类药物常见的特殊杂质。对氨基酚（D对）是对乙酰氨基酚的特殊杂质。